医学伦理学尊重原则应除外的内容是
A. 公平分配卫生资源
B. 尊重病人及家属的自主性或决定
C. 尊重病人的知情同意权
D. 保守病人的秘密
E. 保护病人的隐私

正确答案：A。公平分配卫生资源

解析：公平分配卫生资源属于公正原则，不属于伦理学的尊重原则。掌握“医学伦理的基本原则”知识点。